男，41岁。胃部不适、食欲减退3个月。胃镜检查发现胃窦前壁直径0.5cm的浅溃疡，幽门螺杆菌阳性。超声胃镜示病变侵及浅肌层，病理可见印戒细胞。最适当的治疗是
A. 根除幽门螺杆菌治疗
B. 应用质子泵抑制剂
C. 经胃镜病变黏膜切除术
D. 手术治疗
E. 应用胃粘膜保护剂

正确答案：D。手术治疗

解析：患者中年男性，胃部不适、食欲减退。超声胃镜示病变侵及浅肌层，病理可见印戒细胞提示胃印戒细胞癌。胃印戒细胞癌是一种恶性度较高的低分化腺癌，易在胃壁呈弥漫浸润性生长，侵袭力强，转移率高，经常到了晚期才被发现。印戒细胞癌是一种特殊类型的黏液分泌型腺癌，对化疗多不敏感，目前手术治疗仍为首选（D对）。